胚胎抗原的特点
A. 仅以分泌形成存在
B. 在宿主体内抗原性极弱
C. 仅以膜结合形式存在
D. 胚胎期产生，出生后完全消失
E. 在宿主体内抗原性较强

正确答案：B。在宿主体内抗原性极弱

解析：本题考查胚胎抗原的特点。胚胎抗原的特点在宿主体内抗原性极弱（B对）。胚胎抗原是指在胚胎发育阶段由胚胎组织产生的正常成分，在胚胎后期减少，出生后逐渐消失，或仅存留极微量（D错）；但当细胞癌变时，此类抗原可重新合成而大量表达胚胎抗原，如肝癌细胞产生的甲胎蛋白（AFP），以及结肠癌细胞表达的癌胚抗原（CEA）；胚胎抗原，它们本身的免疫原性均很弱（B对E错），因为曾在胚胎期出现过，宿主对之已形成免疫耐受性，很难引起宿主免疫系统对肿瘤细胞的杀伤效应。胚胎抗原可分为两种，一种是分泌性抗原，由肿瘤细胞产生和释放，如肝癌细胞产生的AFP；另一种是肿瘤细胞表达的膜抗原，如结肠癌细胞表达的CEA（AC错）。